患儿，10个月。因病拟用汤药治疗，每剂药所用药物总量宜掌握在成人量的
A. 1/4～1/5
B. 1/3～1/4
C. 1/2～2/3
D. 1/2～1/3
E. 成人用量

正确答案：D。1/2～1/3

解析：为方便计算，临床上可采用下列比例掌握小儿汤剂方用药总量：新生儿用成人量的 1/6，婴儿为成人量的 1/3 ～1/2, 幼儿及幼童为成人量的 2/3 或用成人量，学龄期儿童用成人量。患儿10月月龄处于婴儿期，中药汤剂用量为成人量1/3～1/2（D对）。